佝偻病活动期
A. 血清钙正常，血清磷明显降低
B. 血清钙磷均降低
C. 血清钙磷正常
D. 血清钙磷低
E. 血清钙磷乘积为30～40

正确答案：B。血清钙磷均降低

解析：本题考查维生素D缺乏性佝偻病活动期的血生化特征。佝偻病活动期的特征性血生化改变是血磷、25（OH）D明显下降，碱性磷酸酶、PTH增高，血清钙稍低或正常低限（B对ACDE错）。